对舌的描述何者错误
A. 颏舌肌两侧收缩时，伸舌向前下
B. 丝状乳头，粘膜上皮中有味蕾
C. 舌根背部粘膜内有舌扁桃体
D. 舌下面中线上有舌系带，其两侧有舌下阜
E. 舌下襞深面有舌下腺

正确答案：B。丝状乳头，粘膜上皮中有味蕾

解析：两侧颏舌肌收缩时，可伸舌向前下(A对)，丝状乳头上不含味蕾(B错，为本题正确答案)，舌根背面粘膜内有舌扁桃体(C对)，舌下面正中线上有舌系带，两侧黏膜隆起为舌下阜(D对)，舌下襞深面有舌下腺(E对)。